常用菌斑染色剂品红溶液的浓度是
A. 1%
B. 2%
C. 0.2%
D. 0.25%
E. 3%

正确答案：B。2%

解析：本题考查菌斑显示剂。常用的菌斑显示剂有赤藓红、碱性品红、荧光素钠等制成的溶液或片剂。常用菌斑染色剂品红溶液的浓度是2%（B对）。